可以导致过敏性休克
A. 青霉素
B. 链霉素
C. A和B均是
D. A和B均不是

正确答案：C。A和B均是

解析：本题考查青霉素和链霉素的不良反应。青霉素、链霉素（C对）可以导致过敏性休克。青霉素在合成、生产过程中会引入杂质，引起过敏反应，甚至发生过敏性休克；链霉素可与血清蛋白质结合形成全抗原，引起过敏反应，严重者可发生过敏性休克。